胰的分部不包括
A. 胰头
B. 胰体
C. 胰颈
D. 胰尾
E. 钩突

正确答案：E。钩突

解析：胰分为头(A对)、体(B对)、颈(C对)、尾(D对)4部分，钩突(E错，为本题正确答案)为胰头的一部分。